腭小凹位于
A. 切牙乳突前方
B. 腭皱与切牙乳突之间
C. 腭皱后方
D. 上颌牙槽嵴后缘
E. 软硬腭交界处，腭中缝两侧

正确答案：E。软硬腭交界处，腭中缝两侧

解析：本题考查无牙颌的解剖标志-腭小凹。腭小凹是口内黏液腺导管的开口，位于上腭中缝后部的两侧，软硬腭连接处的稍后方（E对），上颌总义齿的基托后缘应止于腭小凹后2mm处。切牙乳头（A错）位于上腭前部，两侧尖牙连线与腭中缝相交处，腭小凹位于上腭后部。腭皱与切牙乳突（B错）都位于上腭前部，腭小凹位于上腭后部。腭皱后方（C错）是上腭硬区，腭小凹位于软硬腭连接处的稍后方。上颌牙槽嵴（D错）是牙列缺失患者上颌牙槽骨的顶端，其后缘是上腭前部，腭小凹位于上腭后部。